以下哪种囊肿发生上呼吸道感染后可以骤然增大
A. 皮样囊肿
B. 表皮样囊肿
C. 鳃裂囊肿
D. 鼻腭囊肿
E. 甲状舌管囊肿

正确答案：C。鳃裂囊肿

解析：第二鳃裂囊肿常位于颈上部，大多在舌骨水平，胸锁乳突肌上1/3前缘附近。有时附着于颈动脉鞘的后部，或自颈内、外动脉分叉之间突向咽侧壁。囊肿表面光滑，但有时呈分叶状。肿块大小不定，生长缓慢，患者无自觉症状，如发生上呼吸道感染后可以骤然增大，则感觉不适。若有继发感染，可伴发疼痛，并放射至腮腺区。掌握“甲状舌管囊肿及鳃裂囊肿”知识点。